活血化瘀药的适应病症是
A. 跌打损伤
B. 关节痹痛
C. 痈肿疮疡
D. 瘀滞出血
E. 产后瘀阻

正确答案：A、B、C、D、E。跌打损伤；关节痹痛；痈肿疮疡；瘀滞出血；产后瘀阻

解析：本题考查的是活血化瘀药的适应病症。活血化瘀药的适应病症是跌打损伤（A对）、关节痹痛（B对）、痈肿疮疡（C对）、瘀滞出血（D对）与产后瘀阻（E对）。凡以通利血脉、促进血行、消散瘀血为主要功效的药物，称为活血祛瘀药或活血化瘀药，简称活血药。其中活血作用较强者，又称破血药。本类药味多辛、苦，多归心、肝经而入血分，善走散通利，促进血行。主具活血化瘀之功，并通过活血化瘀而产生调经、止痛、消癥、消肿及祛瘀生新等作用。本类药主要适用于血行不畅、瘀血阻滞所引起的多种疾病，如瘀血内阻之闭经、痛经、月经不调、产后瘀阻腹痛、癥瘕、胸胁脘腹痛、跌打损伤肿痛、瘀血肿痛、关节痹痛、痈肿疮疡、瘀血阻滞经脉所致的出血等。